某中药饮片没有国家的药品标准，可执行的炮制标准是
A. 按照省级药品监督管理部门制定的炮制规范执行
B. 参照《中国药典》功能主治相同的中药饮片的标准执行
C. 参照国家药品监督管理部门颁布的炮制方法相近的药品标准执行
D. 参照国家药品监督管理部门批准的炮制方法相近的药品注册标准执行

正确答案：A。按照省级药品监督管理部门制定的炮制规范执行

解析：本题考查的是药品标准概述。某中药饮片没有国家的药品标准，可执行的炮制标准是按照省级药品监督管理部门制定的炮制规范执行（A对）。国家药品标准的定义：国家药品标准是国家对药品质量要求和检验方法所做的技术规定，是药品生产、供应、使用、检验和管理共同遵循的法定依据。《药品管理法》规定，药品应当符合国家药品标准。经国务院药品监督管理部门核准的药品质量标准高于国家药品标准的，按照经核准的药品质量标准执行；没有国家药品标准的，应当符合经核准的药品质量标准。国务院药品监督管理部门颁布的《中华人民共和国药典》和药品标准为国家药品标准。《药品管理法》还规定，中药饮片必须按照国家药品标准炮制；国家药品标准没有规定的，必须按照省级药品监督管理部门制定的炮制规范炮制。省级药品监督管理部门制定的炮制规范应当报国家药品监督管理部门备案。